不宜与海螵蛸联用的西药有
A. 碳酸氢钠
B. 胃舒平
C. 阿司匹林
D. 四环素族抗生素
E. 胃蛋白酶合剂

正确答案：C、D、E。阿司匹林；四环素族抗生素；胃蛋白酶合剂

解析：本题考查的是中西药不合理联用。不宜与海螵蛸联用的西药有阿司匹林（C对）、四环素族抗生素（D对）与胃蛋白酶合剂（E对）。含钙、镁、铁等金属离子的中药，如石膏、瓦楞子、牡蛎、龙骨、海螵蛸、石决明、赭石、明矾等及其中成药，不能与四环素类抗生素联用，因金属离子可与此类西药形成络合物，而不易被胃肠道吸收，降低疗效。碱性较强的中药及中成药，如瓦楞子、海螵蛸、朱砂等，不宜与酸性药物如胃蛋白酶合剂、阿司匹林等联用，以免因联用而使疗效降低。碳酸氢钠（A错）与胃舒平（B错）不宜与酸性较强的中药及中成药。胃舒平的通用名为复方氢氧化铝，酸性较强的中药及中成药，不可与碱性较强的西药如氨茶碱、复方氢氧化铝、乳酸钠、碳酸氢钠等联用，因与碱性药物发生中和反应后，会降解或失去疗效。